周围血管征不出现在
A. 严重贫血
B. 动脉导管未闭
C. 主动脉瓣关闭不全
D. 心包积液
E. 甲状腺功能亢进症

正确答案：D。心包积液

解析：周围血管征不出现在心包积液，周围血管征是用于检查血管是否正常的一项辅助检查方法是由脉压增大所致，见于严重贫血、动脉导管未闭、主动脉瓣关闭不全、甲状腺功能亢进（D错，为本题正确答案）。